关于上颌中切牙的说法错误的是
A. 唇面近似梯形
B. 舌面中央凹陷舌窝
C. 近中邻面似三角形
D. 唇侧切嵴较圆突
E. 牙根为粗壮较直的单根

正确答案：D。唇侧切嵴较圆突

解析：本题考查上颌中切牙解剖形态特点。唇侧切嵴较圆突（D错，为本题正确答案）不符合上颌中切牙解剖形态特点。上颌中切牙唇侧较平，形成切缘，舌侧圆突形成切嵴。上颌中切牙唇面较平坦，近似梯形（A对），切颈径大于近远中径，近中缘和切缘较直，远中缘略突，颈缘呈弧形，切1/3可见两条纵形发育沟，颈1/3处略突出形成唇面的外形高点。舌面与唇面形态相似但体积略小，中央凹陷形成舌窝（B对），四周为突起的嵴，牙颈部有舌面隆突，近中有近中边缘嵴，远中有远中边缘嵴，切端有切嵴。近中邻面似三角形（C对），顶为切端，底为颈缘，呈V字形，称为颈曲线，曲线的底部至颈缘最低点连线的距离称为颈曲度。牙根为粗壮较直的单根（E对），唇侧宽于舌侧，颈部横切面为圆三角形，向根尖逐渐缩小，根尖较直或略偏远中。